马钱子的性状特征有
A. 扁圆形纽扣状或扁长圆形
B. 表面灰绿色或灰黄色
C. 外表光滑无毛
D. 底面中心有圆点状突起的种脐
E. 边缘有微凸起的珠孔

正确答案：A、B、D、E。扁圆形纽扣状或扁长圆形；表面灰绿色或灰黄色；底面中心有圆点状突起的种脐；边缘有微凸起的珠孔

解析：本题考查的是马钱子药材的性状鉴别。马钱子的性状特征有扁圆形纽扣状或扁长圆形（A对）、表面灰绿色或灰黄色（B对）、底面中心有圆点状突起的种脐（D对）与边缘有微凸起的珠孔（E对）。马钱子：【性状鉴别】药材呈纽扣状圆板形，常一面隆起，一面稍凹下。表面密被灰棕色或灰绿色绢状茸毛（C错），自中间向四周呈辐射状排列，有丝样光泽。边缘稍隆起，较厚，有突起的珠孔，底面中心有突起的圆点状种脐。质坚硬，平行剖面可见淡黄白色胚乳，角质状，子叶心形。气微，味极苦。